胃腺癌的最好发部位是
A. 胃窦
B. 幽门
C. 胃体
D. 贲门
E. 胃底

正确答案：A。胃窦

解析：胃腺癌属于胃的恶性肿瘤，其组织来源于腺上皮细胞，多见于胃窦部小弯侧（A对）。胃间叶源组织良性肿瘤主要有平滑肌瘤、纤维瘤、脂肪瘤、血管瘤、神经纤维瘤等。最常见的为平滑肌瘤，多见于胃体和胃窦部。胃淋巴瘤的病变可以发生在胃的各个部分，但以胃远端2/3后壁和小弯侧多发。